具有散风寒，通鼻窍功效的药物是
A. 桂枝
B. 生姜
C. 防风
D. 辛夷
E. 紫苏

正确答案：D。辛夷

解析：该题考查辛夷的功效，属记忆内容。辛夷，味辛，性温；入肺、胃经；具有发散风寒，通鼻窍的功效（D对ABCE错）。